以下不属于子宫腺肌病临床表现的是
A. 经量增多
B. 经期延长
C. 进行性加重的痛经
D. 子宫均匀增大
E. 小腹疼痛

正确答案：E。小腹疼痛

解析：子宫腺肌病主要表现为经量增多（A对）、经期延长（B对）以及不断发性进行性加剧的痛经（C对），常在经前一周开始下腹正中疼痛，直至月经结束，妇科检查时子宫呈均匀性增大（D对）或有局限性结节隆起，质硬有压痛，经期压痛尤著，其中小腹疼痛（E错，为本题正确答案）不属于子宫腺肌病的临床表现。